区分历史性队列研究与前瞻性队列研究的依据是
A. 依据追踪观察的时间
B. 依据所获结果检验水平
C. 依据暴露程度
D. 依据研究对象进入队列时间
E. 依据论证强度

正确答案：D。依据研究对象进入队列时间